是良好的皮肤消毒剂，可用于医疗器械消毒，但仅用于一般不进入无菌组织的器械灭菌的化学试剂是
A. 乙醇
B. 碘伏
C. 甲醛
D. 含氯消毒剂
E. 戊二醛

正确答案：A。乙醇

解析：乙醇：在醇类中最常用，是良好的皮肤消毒剂。医疗器械消毒，可用70%～80%乙醇浸泡，但仅用于一般不进入无菌组织的器械灭菌，浸泡时间为30分钟。掌握“口外消毒和灭菌”知识点。